国家鼓励下列人员率先献血
A. 工人
B. 农民
C. 知识分子
D. 高等学校在校学生
E. 中等学校在校学生

正确答案：D。高等学校在校学生

解析：国家机关、军队、社会团体、企业事业组织、居民委员会、村民委员会，应当动员和组织本单位或者本居住区的适龄公民参加献血。国家鼓励国家工作人员、现役军人和高等学校在校学生率先献血，为树立社会新风尚作表率。掌握“无偿献血、医疗机构和血站职责及法律责任”知识点。